含有α-羟基苯乙酸酯结构，作用快，持续时间短，用于眼科检查和散瞳的药物是
A. 硫酸阿托品
B. 氢溴酸东莨菪碱
C. 氢溴酸后马托品
D. 异丙托溴铵
E. 丁溴酸东莨菪碱

正确答案：C。氢溴酸后马托品

解析：本题考查常用药物的结构特征与作用。氢溴酸后马托品（C对）含有α-羟基苯乙酸酯结构，为M胆碱受体阻断剂，能散大瞳孔，麻痹睫状肌，临床上用于眼底检查及验光。硫酸阿托品（A错）是一种抗胆碱药，用于胃肠道、胆绞痛、散瞳检查验光、角膜炎、有机磷农药中毒、感染性休克等综合症的治疗。氢溴酸东莨菪碱（B错）含有氧桥结构，中枢作用较强，用于预防和治疗晕动症。异丙托溴铵（D错）含季胺药效团，为M胆碱受体拮抗剂类平喘药。丁溴东莨菪碱（E错）为东莨菪碱季铵化得到的药物，属于外周抗胆碱药。